某患儿所在幼儿园老师反映其身高体重均远远低于同龄儿，为了解其骨骼发育情况，应作下列哪项检查
A. 血常规
B. 胸部X线摄片
C. 肝功能
D. 腰椎穿刺
E. 腕部X线照片

正确答案：E。腕部X线照片

解析：长骨的生长成熟与体格生长有密切的关系，长骨的生长主要由于干骺端软骨骨化、骨膜下成骨。通常采用左手腕、掌、指骨正位X片来了解和判断小儿的骨骼发育年龄。婴儿早期可采用膝部X线片来了解其发育情况。1～9岁儿童骨龄简易计算法：腕部骨化中心的数目约为小儿的年龄加1。骨龄在临床上有重要的诊断价值。掌握“骨骼发育”知识点。